女，25岁。6月下旬来诊，腹泻、呕吐伴轻度腹痛1天。共腹泻6次，开始为黄稀便，继之水样便。呕吐1次，为胃内容物，无发热。粪便检查动力试验（+），碱性蛋白胨水培养有细菌生长。最有可能的诊断是
A. 变形杆菌肠炎
B. 霍乱
C. 空肠弯曲菌肠炎
D. 沙门菌食物中毒
E. 细菌性痢疾

正确答案：B。霍乱

解析：女，25岁。6月下旬来诊，腹泻、呕吐伴轻度腹痛1天（霍乱典型症状）。共腹泻6次，开始为黄稀便，继之水样便。呕吐1次，为胃内容物，无发热。粪便检查动力试验（+），碱性蛋白胨水培养有细菌生长。根据患者症状及实验室检查结果可诊断为霍乱。霍乱是由霍乱弧菌所引起的烈性肠道传染病，发病急、传播快，典型患者由于剧烈的腹泻和呕吐，可引起脱水、肌肉痉挛，严重者导致外周循环衰竭和急性肾衰竭。增菌培养基一般用pH8.4的碱性蛋白胨水，36~37°℃培养6~8h后表面能形成菌膜。此时应进一步作分离培养，并进行动力观察和制动试验，这将有助于提高检出率和早期诊断（B对）。变形杆菌肠炎（A错）有食用海（水）产品或不洁食物史，常先吐后泻，排便前常常有肠鸣、阵发性腹部剧痛。空肠弯曲菌肠炎（C错）初期有头痛、发热、肌肉酸痛等前驱症状，随后出现腹泻、恶心呕吐，腹痛腹泻为最常见症状，表现为整个腹部或右下腹痉挛性绞痛，剧者似急腹征，病变累及直肠、乙状结肠者，可有里急后重。沙门菌食物中毒（D错）依症状的不同可分为5大类型：胃肠炎型、类霍乱型、类伤寒型、类感冒型、败血症型。其中以胃肠炎型最常见，前驱症状有头痛、头晕、恶心、腹痛、寒战。以后出现呕吐、腹泻、发热。大便为黄色或黄绿色、带粘液和血。细菌性痢疾（E错）由志贺菌侵袭肠黏膜，引起肠黏膜炎症及溃疡，临床症状以发热，腹痛，腹泻，里急后重，黏液脓血便为主要特征，有全身中毒症状，粪便或肛拭子检出志贺菌可确诊。